Molish反应呈阳性的化合物是
A. 浓硫酸
B. 浓盐酸
C. 葡萄糖
D. 苯胺
E. 邻苯二甲酸

正确答案：C。葡萄糖

解析：本题考查糖类的显色反应。Molish反应呈阳性的化合物是葡萄糖（C对）。苷类化合物由苷元和糖两部分组成，故苷类化合物能发生相应的苷元和糖的各种显色反应。苷元的结构多种多样。糖的显色反应中最重要的是Molish反应，常用的试剂由浓硫酸和α-萘酚组成。生物碱共轭效应：当生物碱分子中氮原子的孤电子对与开电子基团共轭时，一般使生物碱的碱性减弱。常见的有苯胺（D错）和酰胺两种类型。